上颌骨骨化中心向哪个方向进行生长可以形成上颌骨额突
A. 向前
B. 向后
C. 向内
D. 向外
E. 向上

正确答案：E。向上

解析：上颌骨从这些骨化中心向上形成上颌骨额突并支持眶部。掌握“唾液腺与颌骨的发育”知识点。